患儿，男，6岁。突发咳喘哮鸣，气促，喉间痰鸣，咳痰清稀色白，形寒无汗，面色青灰，张口抬肩，舌苔薄白或白腻，脉浮滑。治疗首选方剂是
A. 小青龙汤合黑锡丹
B. 小青龙汤合三子养亲汤
C. 华盖散
D. 三拗汤合河车大造丸
E. 苏子降气汤

正确答案：B。小青龙汤合三子养亲汤

解析：患儿咳喘哮鸣，气促，喉间痰鸣，咳痰清稀色白，形寒无汗，面色青灰，张口抬肩，舌苔薄白或白腻，脉浮滑。治疗首选方剂是小青龙汤合三子养亲汤。患儿因素体阳虚，或外感风寒，内伤生冷，引动伏痰，则发为寒性哮喘，应温肺散寒，化痰定喘，故首选方剂是小青龙汤合三子养亲汤（B对）。小青龙汤合黑锡丹治疗寒饮伏肺，肾不纳气（A错）。华盖散是主治风寒哮喘的要方（C错）。三拗汤：肺气郁闭，肺气不宣而发咳嗽，河车大造丸用于肺肾两亏证（D错）。苏子降气汤治咳喘痰多证（E错）。